女，34岁，转移性右下腹痛6天发热伴恶心呕吐3天。查体：T38.7°C，腹胀，右下腹触及5cmx3cm肿块，质中，边界不清，有压痛反跳痛，首选治疗措施
A. 穿刺置管引流
B. 全身应用抗生素
C. 手术切除
D. 支持治疗
E. 脓腔内应用抗生素

正确答案：A。穿刺置管引流

解析：女，34岁，转移性右下腹痛（阑尾炎典型症状）6天发热伴恶心呕吐3天。查体：T38.7°C，腹胀，右下腹触及5cmx3cm肿块（提示脓肿局限），质中，边界不清，有压痛反跳痛（提示腹膜刺激征），考虑诊断为阑尾穿孔导致的局限性阑尾周围脓肿，此时宜穿刺置管引流（A对CDE错）。阑尾穿孔形成阑尾周围脓肿时抗生素治疗为常规抗感染治疗，不属于首选（B错）。